为了揭示某现象产生的直接原因和历史原因，问卷中常常要设置
A. 特征问题
B. 态度问题
C. 事实问题
D. 行为问题
E. 其他问题

正确答案：B。态度问题